铸造金合金中铜的优点是
A. 提高合金的强度及硬度
B. 使金合金颜色改变
C. 提高合金的抗沾染性
D. 提高合金的抗腐蚀性
E. 提高金合金的熔点

正确答案：A。提高合金的强度及硬度

解析：本题考查铸造金合金中铜的优点。铜是口腔铸造贵金属合金的重要成分之一，不仅可降低合金的熔点，还能与金形成固溶体而提高其强度（A对）。贵金属合金的组成决定了合金的颜色，在金合金中，铜会增加合金的红色，但这并不能说是铜的优点（B错）。铜基合金的抗腐蚀性较差（D错），其本质上比金、钯等更易从合金中释放出来，将铜加入到金合金中会不仅不会提高合金的抗沾染性，反而会降低合金的抗沾染性（C错）。由于铜基合金的熔点较低，所以金合金中的铜会降低合金整体的熔点（E错）。